与防止血液逆流无关的结构为
A. 纤维环
B. 乳头肌
C. 腱索
D. 瓣膜
E. 肉柱

正确答案：E。肉柱

解析：纤维环（A对）、乳头肌（B对）、腱索（C对）、瓣膜（D对）均为防止血液逆流的结构。肉柱（E错，为本题正确答案）与防止血液逆流无关。